急性毒性试验选择动物的原则是
A. 对化合物毒性反应与人接近的动物
B. 易于饲养管理
C. 操作方便
D. 易于获得，品系纯化，价格低廉
E. 以上都是

正确答案：E。以上都是